某男，45岁。消渴病史2年，症见头晕耳鸣、腰膝酸软、骨蒸潮热、盗汗遗精。医师处以六味地黄丸。2年后，患者再来就诊。症见眩晕耳鸣、羞明畏光、迎风流泪、视物昏花。宜选用的成药是
A. 左归丸
B. 右归丸
C. 杞菊地黄丸
D. 大补阴丸
E. 青娥丸

正确答案：C。杞菊地黄丸

解析：本题考查的是杞菊地黄丸的主治。症见眩晕耳鸣、羞明畏光、迎风流泪、视物昏花。宜选用的成药是杞菊地黄丸（C对）。杞菊地黄丸：【主治】肝肾阴亏，眩晕耳鸣，羞明畏光，迎风流泪，视物昏花。左归丸（A错）：【主治】真阴不足，腰酸膝软，盗汗遗精，神疲口燥。右归丸（B错）：【主治】肾阳不足，命门火衰，腰膝酸冷，精神不振，怯寒畏冷，阳痿遗精，大便溏薄，尿频而清。大补阴丸（D错）：【主治】阴虚火旺，潮热盗汗，咳嗽咯血，耳鸣遗精。青娥丸（E错）：【主治】肾虚腰痛，起坐不利，膝软乏力。